女，20岁，反复高热伴游走性关节痛，口腔干燥、溃疡，脱发月余，化验尿蛋白++，颗粒管型5个/HP，间断有血尿，类风湿因子1：20（+），抗SSA抗体阳性，抗双链DNA抗体阳性。首选治疗药物的最佳组合为
A. 抗疟药+双氯氛酸
B. 非甾类抗炎药+小剂量糖皮质激素
C. 糖皮质激素+甲氨蝶呤
D. 雷公藤+柳氮磺胺吡啶
E. 糖皮质激素+环磷酰胺

正确答案：E。糖皮质激素+环磷酰胺

解析：年轻女性患者（系统性红斑狼疮好发人群），出现反复高热、游走性关节炎、口腔溃疡、脱发月余（系统性红斑狼疮常见症状），化验出现蛋白尿、管型尿及血尿（系统性红斑狼疮肾损害），抗双链DNA抗体阳性（系统性红斑狼疮特异性抗体），考虑患者最可能的诊断为系统性红斑狼疮。患者已出现肾脏受累表现，应使用糖皮质激素冲击治疗，迅速控制病情活动，减轻肾脏损害。同时应用免疫抑制剂治疗，有利于更好地控制SLE活动，延缓病情进展，免疫抑制剂首选环磷酰胺，因此本例患者首选的药物治疗组合为糖皮质激素+环磷酰胺（E对）。双氯芬酸是非甾体类抗炎药，用于关节炎患者减轻疼痛，为对症治疗（AB错）。甲氨蝶呤（C错）为类风湿关节炎的首选治疗用药。雷公藤+柳氮磺吡啶（D错）作为改善病情的抗风湿药，起效慢，通常在治疗2～4个月后才显效果（P803），不能迅速控制SLE病情活动。